关于牙龈癌的叙述，哪项是错误的
A. 多为鳞癌
B. 男性多于女性，以溃疡型最多见
C. 早期向牙槽突及颌骨浸润
D. 下牙龈发病率高于上牙龈
E. 上牙龈癌比下牙龈癌转移早

正确答案：E。上牙龈癌比下牙龈癌转移早

解析：牙龈癌在口腔鳞癌构成比中居第二位或第三位，若分开计算，则下牙龈癌居第三位，上牙龈癌居第五位。男性多于女性。多为分化度较高的鳞状细胞癌，生长较慢，以溃疡型为最多见。早期向牙槽突及颌骨浸润，使骨质破坏，引起牙松动和疼痛。下牙龈癌比上牙龈癌淋巴结转移早，同时也较多见。掌握“鳞状细胞癌概述及舌癌、牙龈癌”知识点。